下列对生命质量评价描述错误的是
A. 生命质量评价的健康状态是从生理、心理和社会生活三个方面来测定个人功能
B. 生命质量评价的内容有：生理状态、心理状态、社会功能状态、主观判断与满意度
C. HRQOL是指在疾病、意外损伤与医疗干预的影响下，测定与个人生活事件相联系的客观健康状态和主观健康状态
D. 生命质量评价的量表主要有：一般健康问卷、疾病专门化问卷、部位专门化问卷、治疗问卷

正确答案：C。HRQOL是指在疾病、意外损伤与医疗干预的影响下，测定与个人生活事件相联系的客观健康状态和主观健康状态

解析：本题考查生命质量评价的相关内容。生命质量评价的健康状态是从生理、心理和社会生活三个方面来测定个人功能（A对）。生命质量评价的内容有：生理状态、心理状态、社会功能状态、主观判断与满意度（B对）。生命质量评价的量表主要有：一般健康问卷、疾病专门化问卷、部位专门化问卷、治疗问卷（D对）。HRQOL即健康相关生命质量，是指在病伤、医疗干预、老化和社会环境改变的影响下个人的健康状态，以及与其经济、文化背景和价值取向相联系的主观满意度（C错，为本题正确答案）。